可出现发热伴眼结膜充血的是
A. 尿路感染
B. 支气管肺炎
C. 流感
D. 麻疹
E. 肠炎

正确答案：D。麻疹

解析：发热是指机体在致热源作用下或各种原因引起体温调节中枢的功能障碍时，体温升高超过正常范围。可出现发热伴眼结膜充血的是麻疹（D对）。尿路感染（A错）如急性肾盂肾炎和支气管肺炎（B错）可出现发热伴寒战。流感（C错）可出现发热伴单纯疱疹。肠炎（E错）可出现发热伴腹痛。